以多成分制备的中药注射剂，其中结构明确的成分含量应不低于其总固体量的
A. 0.5
B. 0.6
C. 0.7
D. 0.8
E. 0.9

正确答案：D。0.8

解析：本题考查的是注射用中药原料。以多成分制备的中药注射剂，所测成分应大于固体总量的80%（D对）。按照《中药、天然药物注射剂基本技术要求》的规定，有效成分制成的中药注射剂，主药成分含量应不少于90%（E错）；多成分制成的中药注射剂，所测成分应大于总固体量的80%。